不属于药物经济学评价对象的是
A. 不同药物治疗方案
B. 药物治疗方案与手术治疗方案关系
C. 药物治疗方案与社会服务项目关系
D. 手术治疗方案与社会服务项目关系
E. 药物治疗方案与药物预防方案关系

正确答案：D。手术治疗方案与社会服务项目关系